不能用生理性妊娠解释的是
A. 血液处于高凝状态
B. 红细胞沉降率增强
C. 纤溶活性降低
D. 血容量增加
E. 四肢水肿卧床休息后不消退

正确答案：E。四肢水肿卧床休息后不消退

解析：妊娠晚期增大的子宫压迫下腔静脉，阻碍血液回流，常有踝部、小腿下半部轻度水肿，休息后消退，属生理现象。睡眠取左侧卧位时能使下肢血液回流改善，水肿减轻。若四肢水肿卧床休息后不消退（E错，为本题正确答案），应考虑到妊娠合并肾脏疾病、低蛋白血症等。妊娠期血液的生理性改变（P38）有：1. 血容量增加（D对）妊娠期循环血容量增加以适应子宫胎盘及组织器官增加的血流量。2. 血液处于高凝状态（A对）凝血因子Ⅱ、Ⅴ、Ⅶ、Ⅷ、Ⅸ、Ⅹ增加，仅凝血因子Ⅺ、ⅩⅢ降低。3. 血浆纤维蛋白原含量比非孕期增加50%，纤维蛋白原改变了红细胞表面负电荷，出现红细胞钱串样反应（八年制妇产科学第2版P43）使红细胞沉降率加快（B对）。4. 纤维蛋白溶酶原增加，优球蛋白溶解时间延长（八年制妇产科学第2版P43）使纤溶活性降低（C对）。